硫化氢中毒的机制是
A. 该气体与细胞色素氧化酶中三价铁和谷胱甘肽结合抑制细胞呼吸酶
B. 该气体与氧化型细胞色素氧化酶中的二价铁结合，引起细胞内窒息
C. 使血氧饱和度增加，组织不能利用氧
D. 引起氧分压增加，导致组织供氧不足，引起缺氧
E. 影响血液中氧的释放和传递，导致低氧血症和组织缺氧

正确答案：A。该气体与细胞色素氧化酶中三价铁和谷胱甘肽结合抑制细胞呼吸酶

解析：硫化氢与细胞色素氧化酶中三价铁和谷胱甘肽结合抑制细胞呼吸酶（A对），影响细胞氧化过程，造成组织缺氧。一氧化碳与还原型细胞色素氧化酶中的二价铁结合，引起细胞内窒息（B错）。一氧化碳中毒会影响血液中氧的释放和传递，导致低氧血症和组织缺氧（E错）。